《2000年世界卫生报告》中指出，中国居民平均健康水平在191个国家中位居
A. 78位
B. 101位
C. 81位
D. 20位
E. 122位

正确答案：C。81位

解析：本题考查中国居民平均健康水平的位置。《2000年世界卫生报告》中指出，中国居民平均健康水平在191个国家中位居81位（C对ABDE错）。